男，3天，第一胎足月顺产，出生18小时发现皮肤黄染，吃奶好。体检：反应好，皮肤巩膜中度黄染，肝肋下2cm，子血型“B”，母血型“O”，血清胆红素257μmol/L（15mg/dl）最可能的诊断为
A. 新生儿肝炎
B. 败血症
C. 新生儿ABO溶血病
D. 新生儿Rh溶血病
E. 胆道闭锁

正确答案：C。新生儿ABO溶血病

解析：子血型“B”，母血型“O”，除黄疸外无明显其它异常，应诊断为新生儿ABO溶血病（C对）。而新生儿Rh溶血病一般发生在Rh阴性的母亲在生第二胎时，胎儿是Rh阳性的情况，其临床症状一般较重，该病例不符合新生儿Rh溶血病的特点（D错）。新生儿肝炎：在围生期一般有宫内感染的病史，胎儿出生后有明显肝功能损害的临床表现。因此不能诊断为新生儿肝炎（A错）。败血症一般表现为反应差、嗜睡、发热或体温不升、少吃、少哭、少动、体重不增或增长缓慢等症状，而该患儿出有黄疸的临床表现外其它情况都很好，与败血症的表现不符（B错）。该病例是由血型原因引起的黄疸，并不是由解剖因素所导致的黄疸，不能诊断为胆道闭锁（E错）。